急性链球菌感染后所致的肾小球肾炎，与肾小球滤过率降低无关的是
A. 内皮细胞增生肿胀
B. 肾小球毛细血管腔狭窄
C. 肾小球系膜细胞增生
D. 毛细血管壁基底膜明显增厚
E. 肾小球缺血

正确答案：E。肾小球缺血

解析：影响肾小球率过滤有三大因素：有效滤过压、肾小球血浆流量、滤过膜通透性和滤过面积的改变。急性链球菌感染后的急性肾小球肾炎的病理改变为：弥漫性毛细血管内皮增生（A对）、毛细血管壁基底膜明显增厚（D对）及系膜增殖性改变（C对），轻者可见肾小球血管内皮细胞有轻中度增生，系膜细胞也增多，重者增生更明显，且有炎症细胞浸润等渗出性改变。增殖的细胞及渗出物可引起肾小球毛细血管官腔狭窄（B对），引起肾血流量及肾小球率过滤下降。肾小球缺血与急性链球菌感染后肾小球肾炎时肾小球滤过率降低无关（E错，为本题正确答案）。